汽车尾气生成的二次污染物是
A. 温室效应
B. 光化学烟雾
C. 汞的甲基化
D. 酸雨
E. 水体富营养化

正确答案：B。光化学烟雾

解析：本题考查光化学烟雾。光化学烟雾（B对ACDE错）是汽车、工厂等污染源排入大气的碳氢化合物（HC）和氮氧化物（NOx）等一次污染物在阳光（紫外光）作用下发生光化学反应生成二次污染物后与一次污染物混合所形成的有害浅蓝色烟雾。